大补阴丸中既能填精补阴，又能制约黄柏枯燥的药物是
A. 熟地黄
B. 龟板
C. 知母
D. 猪脊髓
E. 山茱萸

正确答案：D。猪脊髓

解析：大补阴丸方中熟地益髓填精；龟板为血肉有情之品，擅补精血，又可潜阳，二药重用，意在大补真阴，壮水制火以培其本，共为君药。黄柏，知母清热泻火，滋阴凉金，相须为用，泻火保阴以治其标，并助君药滋润之功，同为臣药。再以猪脊髓，蜂蜜为丸，取其血肉甘润之质，助君药填精补阴，兼制黄柏之苦燥（D对），用为佐药。诸药合用，使水充而亢阳有制，火降则阴液渐复，共收滋阴填精，清热降火之功。